硝苯地平含量测定使用的滴定液是
A. 高氯酸滴定液
B. 溴酸钾滴定液
C. 硫酸铈滴定液
D. 硫代硫酸钠滴定液
E. 乙二胺四醋酸二钠滴定液

正确答案：C。硫酸铈滴定液

解析：本题考查含量测定。硝苯地平含量测定使用的滴定液是硫酸铈滴定液（C对）。硝苯地平具有还原性，可在酸性溶液中以邻二氮菲为指示剂，用铈量法直接滴定，《中国药典》对硝苯地平收载的方法也是铈量法。高氯酸滴定液（A错）为非水碱量法所用，可用来测定地西泮含量。溴酸钾为滴定液（B错）为溴酸钾法所用。硫代硫酸钠滴定液（D错）是碘量法所用，属于氧化还原滴定法。乙二胺四醋酸二钠滴定液（E错）是配位滴定法所用。